复苏能否成功的关键在于
A. 脑复苏
B. 恢复有效心律
C. 保护脑组织
D. 建立人工循环
E. 维持血压

正确答案：A。脑复苏

解析：心肺复苏过程中，心跳的恢复或循环功能的初步稳定并非复苏的终结，因为缺血、缺氧所致的机体生理改变并未随心跳的恢复而立即好转。复苏后处理的重点和主要的内容是防治多器官功能衰竭和减轻脑损害，争取脑功能的全面复苏（A对）。心跳恢复后，心血管功能处于不稳定状态，主要表现为低血压和组织器官灌注不足。此时应进一步通过监测，了解有无休克、心律失常、血容量不足、酸碱失衡和电解质紊乱，判断有无心包填塞（可由心内注射引起）、肺水肿、张力性气胸等（B错）。心跳骤停后，随着循环的停止，脑血流中断，脑细胞缺血、缺氧，脑功能和代谢迅速受损甚至停止。由于脑细胞是人体对缺氧最敏感的细胞，因此CPR后心跳、呼吸恢复并不意味着脑功能也迅速恢复，而是需要采取各种措施维持脑细胞内外环境（颅内和颅外）稳定以改善和解除缺血所致的脑损害（C错）。人工循环建立的迟早与效果对患者预后有重要影响。主要方法是按压心脏、维持心脏的充盈和搏动，有效时可诱发心脏的自律搏动（D错）。提高血压，增加心脏和脑血流量（E错）。